仅接受对侧皮质核束纤维
A. 舌下神经核
B. 动眼神经核
C. 滑车神经核
D. 面神经核上部
E. 疑核

正确答案：A。舌下神经核

解析：由中央前回下部发出的皮质核束下行经内囊膝至大脑脚底中3/5的内侧部，由此向下陆续分出纤维，大部分纤维终止于并支配双侧脑神经运动核（BCDE错）除外面神经核下部、舌下神经核。面神经核下部、舌下神经核（A对）仅接受对侧皮质核束纤维。